依那普利抗高血压作用的机制为
A. 抑制血管紧张素转化酶的活性
B. 干扰细胞核酸代谢
C. 补充体内物质
D. 影响机体免疫功能
E. 阻滞细胞膜钙离子通道

正确答案：A。抑制血管紧张素转化酶的活性

解析：本题考查依那普利。依那普利抗高血压作用的机制为抑制血管紧张素转化酶的活性（A对）。干扰细胞核酸代谢的物质为氟尿嘧啶（B错）。补充体内物质（C错）是一种对饮治疗的方法。影响机体免疫功能发挥疗效（D错）的有免疫调节药。阻滞细胞膜钙离子通道的为钙离子阻滞剂，包括二氢吡啶类和地尔硫卓类药物（E错）。